针刺出血试验时针头刺入皮瓣的深度为
A. 0.1cm
B. 0.2cm
C. 0.3cm
D. 0.4cm
E. 0.5cm

正确答案：E。0.5cm

解析：针刺出血试验：对一些皮瓣颜色苍白，无法马上判断是否为动脉堵塞所致时，可采用此法。要求在无菌状态下进行，以7号针头刺入皮瓣深达0.5cm，并适当捻动针头，拔起后轻挤周围组织，如见鲜红血液流出，提示动脉血供良好，否则提示动脉危象。掌握“皮瓣移植”知识点。